干扰素（IFN）抗病毒的作用机制是
A. 干扰病毒的吸附
B. 干扰病毒的穿入
C. 直接干扰病毒mRNA的转录
D. 诱导邻近细胞产生抗病毒蛋白
E. 干扰病毒的释放

正确答案：D。诱导邻近细胞产生抗病毒蛋白

解析：干扰素（IFN）：不能直接灭活病毒，而是通过诱导细胞合成抗病毒蛋白（AVP）发挥效应。干扰素的作用机制：IFN不是直接作用于病毒，而是作用于邻近细胞的IFN特异受体系统，诱生合成20多种抗病毒蛋白，主要有2’-5’寡腺苷酸合成酶（2’-5’A合成酶）、磷酸二酯酶和蛋白激酶等。这些抗病毒蛋白质可抑制病毒核酸的复制及病毒蛋白质的合成，使病毒不能增殖。IFN除了抗病毒作用外，还有免疫调节功能和抑制肿瘤细胞生长的功能。Ⅱ型IFN的免疫调节功能和抑制肿瘤细胞生长的功能比Ⅰ型强，而抗病毒作用，则I型IFN强于Ⅱ型。掌握“病毒传播方式、感染类型、致病机制及免疫”知识点。